以下促进健康的行为中，属于二级预防的是
A. 保健行为
B. 预警行为
C. 求医行为
D. 遵医行为
E. 戒除不良嗜好行为

正确答案：C。求医行为